好发于鼻腔、鼻咽部、腭部、皮肤、软组织、胃肠道的淋巴瘤是
A. 弥漫性大B细胞淋巴瘤
B. MALT淋巴瘤
C. 结外NK/T细胞淋巴瘤，鼻型
D. 恶性黑色素瘤
E. Burkitt淋巴瘤

正确答案：C。结外NK/T细胞淋巴瘤，鼻型

解析：结外NK/T细胞淋巴瘤，鼻型好发于鼻腔、鼻咽部、腭部、皮肤、软组织、胃肠道等。掌握“恶性淋巴瘤”知识点。